骨化性纤维瘤最易好发于
A. 上颌骨
B. 下颌骨
C. 颈正中线
D. 口底区
E. 面颊部

正确答案：B。下颌骨

解析：骨化性纤维瘤常见于年轻人，多为单发性，可发生于上、下颌骨，但以下颌较为多见。掌握“骨化纤维瘤”知识点。